小儿身高80cm，前囟门已闭，头围48cm，乳牙20枚，会跳并能用简单的语言表达自己的需要，对人事有喜乐之分。此小儿的年龄是
A. 10个月
B. 1岁
C. 2岁
D. 3岁
E. 4岁

正确答案：C。2岁

解析：2岁（C对）小儿身高80cm左右，前囟门闭合，头围48cm，乳牙可出齐20枚，能双脚跳，会用简单的语言表达自己的需要，可对人事表现出自己的喜乐感受。10个月（A错）小儿身高约70cm，前囟可未完全闭合，头围44～45cm，出牙2～6枚，只能独站片刻，尚只能说单词。3岁（D错）小儿身高约1m头围约50cm，可单足跳，上下楼梯，已能表现自尊心、同情心、害羞等情感。4岁（E错）身高约105cm，前囟门已经闭合完全，头围已达50cm，会唱歌，有初步的逻辑思维能力，并随着集体活动的增加会表现出基本的社会性情感和道德体验。